兴奋性突触后电位是突触后膜对哪种离子的通透性增加引起的
A. K⁺和Ca²⁺
B. Na⁺和K⁺，尤其是K⁺
C. Na⁺和K⁺，尤其是Na⁺
D. Na⁺和Ca²⁺
E. Cl⁻

正确答案：C。Na⁺和K⁺，尤其是Na⁺